右心功能不全所致的心源性水肿主要由于
A. 淋巴液回流受阻
B. 血浆胶体渗透压降低
C. 毛细血管静水压增高
D. 毛细血管通透性增加
E. 心源性肝硬化白蛋白合成减少

正确答案：C。毛细血管静水压增高

解析：右心功能不全所致心源性水肿的发生机制主要是:有效循环血量减少，肾血流量减少，继发性醛固酮增多引起钠水潴留以及静脉淤血，毛细血管滤过压增高，组织液回吸收减少所致。肝源性水肿形成主要与门脉高压症、低蛋白血症、肝淋巴液回流障碍、继发醛固酮增多等因素有关。掌握“心力衰竭”知识点。